鼻腭管囊肿的病理特征是
A. 纤维囊壁中含有较多淋巴滤泡
B. 纤维囊壁中含有较多的上皮团块
C. 纤维囊壁中含有较大的血管和神经束
D. 纤维囊壁中含有较大的淋巴管
E. 纤维囊壁中含有较多的皮脂腺

正确答案：C。纤维囊壁中含有较大的血管和神经束

解析：鼻腭管囊肿可内衬复层扁平上皮、含黏液细胞的假复层纤毛柱状上皮、立方上皮或柱状上皮，这些上皮类型可单独或联合存在。邻近口腔部的囊肿常内衬复层扁平上皮，而近鼻腔部者常为呼吸性上皮。结缔组织囊壁内可含有较大的血管和神经束，为通过切牙管的鼻腭神经和血管结构，囊壁内有时可见小灶性黏液腺和散在的慢性炎细胞浸润。掌握“鼻腭管囊肿及鼻唇囊肿”知识点。